观察时间短、研究对象少，适合研究一些慢性病和一些比较少见的疾病是哪种流行病学调查的特点
A. 病例-对照研究
B. 群组研究
C. 常规资料分析
D. 横断面研究
E. 纵向研究

正确答案：A。病例-对照研究

解析：本题考查病例-对照研究的定义。观察时间短、研究对象少，适合研究一些慢性病和一些比较少见的疾病是病例-对照研究（A对）的特点。先按疾病状态，确定调查对象，选择有特定疾病的人群组，与未患这种疾病的对照组，比较两组人群过去暴露于某种可能危险因素的程度，分析暴露是否与疾病有关。此种调查方法为病例-对照研究。群组研究（B错）是将特定人群按其是否暴露于某因素分为两组，追踪观察一定时间，比较两组的发病率，以检验该因素与某疾病联系的假设。常规资料分析（C错）又称历史资料分析，即对已有的资料或者疾病监测记录做分析或总结。横断面研究（D错）又称现况调查，调查目标人群中某种疾病或现象在某一特定时点的情况。纵向研究（E错）又称疾病监测，即研究疾病或某种情况在一个人群中随着时间推移的自然动态变化。